非选择性环加氧酶抑制药有
A. 布洛芬
B. 舒林酸
C. 吡罗昔康
D. 美洛昔康
E. 吲哚美辛

正确答案：A、B、E。布洛芬；舒林酸；吲哚美辛

解析：本题考查非选择性环氧酶抑制药。布洛芬（A对）、舒林酸（B对）、吲哚美辛（E对）属于非选择性环氧酶抑制药；吡罗昔康（C错）及美洛昔康（D错）为昔康类非甾体抗炎药，该类药对COX-2的抑制作用比对COX-1的作用强，解热镇痛抗炎作用增强，而胃肠道不良反应减轻。